含有高分子材料的液体制剂是
A. 洗剂
B. 涂剂
C. 涂膜剂
D. 贴膏剂
E. 搽剂

正确答案：C。涂膜剂

解析：本题考查涂膜剂。含有高分子材料的液体制剂是涂膜剂（C对）。涂膜剂系指原料药物溶解或分散于含成膜材料的溶剂中，涂布患处后形成薄膜的外用液体制剂；洗剂（A错）为供清洗或涂抹无破损的皮肤或腔道的外用液体制剂；涂剂（B错）为涂于皮肤或口腔喉部黏膜的液体制剂；贴膏剂（D错）系指药材提取物和（或）化学药物与适宜的基质和基材制成的供皮肤贴敷，可产生局部或全身作用的一类片状外用制剂；搽剂（E错）为供无破损的皮肤揉搽用的制剂。